患者，女，70岁，拟行膝关节置换术，无磺胺类药过敏史，皮试结果呈阴性。体征和实验室检查：低热，无感染，空腹血糖4.6mmol/L。手术医师处方抗菌药物预防感染。首选的抗菌药物是
A. 阿奇霉素
B. 头孢唑林
C. 万古霉素
D. 克林霉素
E. 磺胺嘧啶

正确答案：B。头孢唑林

解析：本题考查头孢唑林。头孢唑林（B对）是头孢菌素类抗菌药，主要用于繁殖期杀菌，是围术期预防性的抗菌药。阿奇霉素（A错）是大环内酯类抗菌药，主要用于急性咽炎肺炎等炎症疾病。万古霉素（C错）是多肽类抗菌药物，用于对其敏感的多重耐药菌所致的重症感染。由于其具有肾毒性，故不常用于围术期预防感染。克林霉素（D错）是林可霉素类抗菌药，主要用于革兰阳性菌所致的感染。磺胺嘧啶（E错）是磺胺类抗菌药，主要用于敏感细菌及病原微生物所致的感染。